世界卫生组织推荐作为反映致癌强度的指标是
A. 基准剂量
B. 耐受摄入量
C. 暂定耐受摄入量
D. 容许摄入量
E. 急性参考剂量

正确答案：A。基准剂量

解析：本题考查世界卫生组织推荐作为反映致癌强度的指标。世界卫生组织推荐用基准剂量（A对BCDE错）作为反映致癌强度的指标，利用基准剂量和暴露限量对其进行危险性评估，基准剂量除以人群估计摄入量，则为暴露限量。暴露限量越小，该物质致癌危险性也就越大，反之就越小。